白喉杆菌、产气荚膜梭菌产生外毒素是因为其基因发生了
A. 转化
B. 转导
C. 接合
D. 突变
E. 溶原性转换

正确答案：E。溶原性转换

解析：溶原性转换指温和噬菌体感染细菌（称为溶原菌）后，以前噬菌体形式与溶原菌的染色体整合，导致溶原菌的基因型改变及获得新的遗传特征。经过溶原性转换，如白喉棒状杆菌、产气荚膜梭菌和肉毒梭菌等，可分别变为产生白喉毒素、α毒素和肉毒毒素的产毒株。掌握“细菌遗传变异的物质基础及机制”知识点。